哪个牙的颊尖偏远中
A. 上颌乳尖牙
B. 下颌乳尖牙
C. 上颌第一双尖牙
D. 上颌第一乳磨牙
E. 下颌第一乳磨牙

正确答案：C。上颌第一双尖牙

解析：本题考查颊尖偏远中的牙齿。上颌第一前磨牙颊尖和乳尖牙牙尖偏远中。上颌第一双尖牙（C对）即上颌第一前磨牙，颊尖的近中斜缘长于远中斜缘，因此颊尖偏远中，是前磨牙中唯一的颊尖偏向远中者。上颌乳尖牙（A错）牙尖偏远中，是其最主要的解剖特征，但仅有一牙尖，无颊舌之分。下颌乳尖牙（B错）远中斜缘长于近中斜缘，牙尖偏近中。上颌第一乳磨牙（D错）颊尖微突，略偏近中。下颌第一乳磨牙（E错）牙尖略偏近中。